关于注射剂的正确表述有
A. 肌内注射的吸收程度一般与静注相当
B. 药物混悬局部注射后，可发挥长效作用
C. 皮下注射药物的吸收比肌内注射快
D. 皮内注射只适用于某些疾病的诊断和药物的过敏试验
E. 鞘内注射可透过血脑屏障，使药物向脑内分布

正确答案：A、B、D、E。肌内注射的吸收程度一般与静注相当；药物混悬局部注射后，可发挥长效作用；皮内注射只适用于某些疾病的诊断和药物的过敏试验；鞘内注射可透过血脑屏障，使药物向脑内分布

解析：本题考查注射给药的给药部位和吸收途径。肌内注射与静脉注射的吸收程度相当（A对）；药物混悬局部注射后在局部形成储库，缓慢释放药物，可发挥长效作用（B对）；皮下注射的吸收比肌内注射慢（C错），真皮中血管稀小，吸收差，故皮内注射只用于诊断与过敏试验（D对）；鞘内注射是注射到椎管，进入蛛网膜下腔到达脑脊液，可透过血脑屏障，使药物向脑内分布（E对）。